前间壁心肌梗死的特征性心电图改变导联多见于
A. V1～V3
B. V3～V5
C. V1～V6
D. Ⅱ、Ⅲ、aVF
E. V3R～V7R

正确答案：A。V1～V3

解析：前间壁心肌梗死特征性ECG改变见于V1～V3导联（A对）；前壁心肌梗死特征性ECG改变见于V3～V5导联（B错）；广泛前壁心肌梗死特征性ECG改变见于V1～V6导联（C错）；下壁心肌梗死特征性ECG改变见于Ⅱ、Ⅲ、aVF导联（D错）；右室心肌梗死特征性ECG改变见于V3R～V7R导联（E错）。